关于队列研究，下列哪一项是正确的
A. 不能计算AR值
B. 适用于罕见病
C. 随机分组
D. 可以研究一种暴露与多种结局的关系
E. 研究周期短，省时省力

正确答案：D。可以研究一种暴露与多种结局的关系